片剂重量差异超限的产生原因有
A. 颗粒的流动性不好
B. 颗粒中的细粉太多
C. 颗粒的大小相差悬殊
D. 加料斗内颗粒是多时少
E. 冲头与模孔的吻合性不好

正确答案：A、B、C、D、E。颗粒的流动性不好；颗粒中的细粉太多；颗粒的大小相差悬殊；加料斗内颗粒是多时少；冲头与模孔的吻合性不好